三级预防包括
A. 降低或减少劳动者接触职业性有害因素水平
B. 通过健康监护，早期发现职业损害
C. 对职业病患者进行及时治疗和处理
D. 建立和健全组织领导机构
E. 引进先进的设备与工艺

正确答案：C。对职业病患者进行及时治疗和处理

解析：本题考查第三级预防的内容。第三级预防是指在患病以后，给予积极治疗和促进康复的措施（C对ABDE错）。第三级预防原则主要包括：①对已有健康损害的接触者应调离原有工作岗位，并结合合理的治疗；②根据接触者受到健康损害的原因，对生产环境和工艺过程进行改进，既能治疗病人，又能加强一级预防；③促进病人康复，预防并发症的发生和发展。